男，36岁。患十二指肠溃疡3年。运动后头晕，出冷汗，吐鲜血数口。查体：呼吸浅促，脉搏细速，血压降为80/60mmHg。估计其出血量至少
A. 200ml
B. 300ml
C. 500ml
D. 600ml
E. 800ml

正确答案：E。800ml

解析：患者十二指肠溃疡病史3年，运动后头晕出冷汗，吐鲜血数口，应考虑十二指肠溃疡大出血。呼吸浅促，脉搏细速，血压降为80/60mmHg，提示出现失血性休克。休克分为三度：①轻度休克：脉搏＜100次/分，收缩压正常或稍增高，舒张压增高，估计失血量20%以下（＜800ml）；②中度休克：脉搏100～200次/分，收缩压90～70mmHg，估计失血量20%～40%（800～1600ml）；③重度休克：脉搏细弱甚至不能清楚触及，收缩压＜70mmHg或测不到，估计失血量40%以上（＞1600ml）。本题患者脉搏细速，收缩压为80mmHg，为中度休克，失血量至少为800ml（E对）。